因含有剧毒的马钱子粉而不能过量或持久服用的成药是
A. 七厘散
B. 跌打丸
C. 接骨丸
D. 舒筋活血片
E. 接骨七厘片

正确答案：C。接骨丸

解析：本题考查的是接骨丸的注意事项。因含有剧毒的马钱子粉而不能过量或持久服用的成药是接骨丸（C对）。接骨丸：【注意事项】本品所含马钱子粉有大毒，故应在医生指导下使用。孕妇禁用。骨折、脱臼者应先复位后再用本品治疗。切勿过量服用或持久服用。七厘散（A错）：【注意事项】本品应在医生指导下使用。孕妇禁用。骨折、脱臼者宜手法先复位后，再用本品治疗。不宜过量服用或长期服用。饭后服用可减轻肠胃反应。皮肤过敏者不宜使用。跌打丸（B错）：【注意事项】孕妇禁用。骨折、脱臼者宜手法先复位后再用本品治疗。饭后服用可减轻肠胃反应，脾胃虚弱者慎用。舒筋活血片（D错）：【使用注意】孕妇忌服。妇女月经期慎服。因所用的香加皮含强心苷有毒，故不宜过量或持久服，禁与含强心苷类的西药同用。接骨七厘片（E错）：【注意事项】孕妇禁用。骨折、脱臼者应先复位后再用本品治疗。脾胃虚弱者慎用。